可以降低血尿酸水平，但升高尿酸水平而易导致肾结石的抗痛风药是
A. 秋水仙碱
B. 别嘌醇
C. 丙磺舒
D. 呋塞米
E. 布洛芬

正确答案：C。丙磺舒

解析：本题考查丙磺舒。可以降低血尿酸水平，但升高尿酸水平而易导致肾结石的抗痛风药是丙磺舒（C对）。丙磺舒可抑制近端肾小管对尿酸盐的重吸收，使尿酸排出增加，从而降低血尿酸浓度，减少尿酸沉积，亦促进尿酸结晶的重新溶解。不良反应可引起肾结石。秋水仙碱（A错）用于痛风的急性期、痛风性关节炎急性发作和预防。别嘌醇（B错）尤其适用于血尿酸和24小时尿尿酸过多或有痛风结石、肾结石、泌尿系统结石、不宜应用促进尿酸排出药者，服后一般24小时起效，2～4周下降最为明显。呋塞米（D错）是高效利尿药。布洛芬（E错）主要用于风湿性及类风湿性关节炎。